第二乳磨牙早失，第一恒磨牙完全萌出，应选择
A. 带环（全冠）丝圈保持器
B. Nance腭弓式间隙保持器
C. 远中导板保持器
D. 充填式保持器
E. 可摘式功能性保持器

正确答案：A。带环（全冠）丝圈保持器

解析：本题考查乳牙早失及间隙管理。带环（全冠）丝圈保持器（A对）适应证：单侧或双侧单个乳磨牙早失；第二乳磨牙早失，第一恒磨牙完全萌出。如果基牙牙冠破坏较大，可以制作预成冠式丝圈保持器。